关于颞间隙临床特点的叙述中，不正确的是
A. 病变区表现有凹陷性水肿
B. 颞深间隙脓肿易触及波动感
C. 可有不同程度的开口受限
D. 病变区有压痛、咀嚼痛
E. 深部脓肿难以自行穿破，可引起颞骨骨髓炎

正确答案：B。颞深间隙脓肿易触及波动感

解析：颞间隙临床特点：取决于是单纯颞间隙感染，还是伴有相邻多间隙感染，肿胀范围可仅限于颞部或同时有腮腺咬肌区、颞部、眶部、颧部等区域的广泛肿胀，病变区表现有凹陷性水肿；压痛、咀嚼痛和不同程度的开口受限。脓肿形成后，颞浅间隙脓肿可触及波动感，颞深间隙脓肿则需借助穿刺才能明确诊断。掌握“颞间隙、咽旁间隙感染”知识点。